肾上腺素的药理作用包括
A. 心率加快
B. 骨骼肌血管血流增加
C. 收缩压下降
D. 促进糖原合成
E. 扩张支气管

正确答案：A、B、E。心率加快；骨骼肌血管血流增加；扩张支气管

解析：本题考查肾上腺素的药理作用。肾上腺素α和β受体激动药，其药理作用主要表现为兴奋心血管系统、抑制支气管平滑肌和促进新陈代谢。肾上腺素可直接作用于心肌、窦房结和传导组织的β₁和β₂受体，使心肌收缩力增强、心率加快（A对）、传导加速、兴奋性加强。作用于骨骼肌血管时β受体占优势，可产生舒张作用，骨骼肌血管血流增加（B对）。肾上腺素激动支气管平滑肌的β₂受体，使支气管平滑肌松弛（E对），当支气管痉挛时其舒张作用更为明显。肾上腺素对血压的影响与用药剂量和给药速度有关。在极小剂量下，收缩压和舒张压均下降。皮下注射治疗量或慢速静脉滴注时，心肌收缩力增强，心排出量增加，故收缩压升高（C错）；因骨骼肌血管的舒张作用抵消或超过皮肤、黏膜和腹腔内脏血管的收缩作用，故舒张压不变或下降，脉压增加，有利于血液对各组织器官的灌注。肾上腺素能增强机体代谢。治疗量可使耗氧量增加20%～30%。通过激动肝脏的α受体和β₂受体促进肝糖原分解（D错）和糖异生，导致血糖升高。